下列哪项答案是正确的
A. 水体自净主要受河水流量、河床构造影响
B. 河水复氧速度与排污量有关
C. 河水溶解氧与水温有关
D. 水温越高，溶解氧含量越高
E. 水温越高，溶解氧饱和差越小

正确答案：C。河水溶解氧与水温有关

解析：本题考查溶解氧的相关内容。溶解氧指溶解在水中的氧含量。其含量与空气中的氧分压、水温有关（C对ABE错）。一般而言，同一地区空气中的氧分压变化甚微，故水温是主要的影响因素，水温愈低，水中溶解氧含量愈高（D错）。